子宫内膜癌的确诊方法应是
A. 细胞学涂片
B. 磁共振成像
C. 血清CA125测定
D. 淋巴造影
E. 分段诊刮

正确答案：E。分段诊刮

解析：诊断子宫内膜癌最可靠的方法是分段诊刮（E对）。如果临床或影像学检查怀疑子宫内膜癌，应行分段诊刮，明确诊断。细胞学涂片（P404）（A错）适用于恶性肿瘤的初步筛选，不作为确诊依据。磁共振成像（P316）（B错）对肌层浸润深度和宫颈间质浸润有较准确的判断，但是不能确诊。血清CA125测定（P316）（C错）在有子宫外转移者会升高，也可作为疗效观察指标，仍需病理组织学检查进行确诊。淋巴造影（D错）主要用于了解盆腔及主动脉旁淋巴结有无转移。